何者错误
A. 穿腮腺实质
B. 行经面神经管
C. 经茎乳孔出颅
D. 有分支司腮腺分泌
E. 出腮腺后呈扇形分为五支

正确答案：D。有分支司腮腺分泌

解析：有分支司腮腺分泌（D错，为本题正确答案）的神经是舌咽神经，而非面神经。面神经为混合性脑神经，连于脑桥延髓沟外侧部，经内耳门、内耳道达内耳道底，穿内耳道底入面神经管（B对），最后经茎乳孔出颅（C对）。出茎乳孔后穿腮腺实质（A对），出腮腺后呈扇形分为五支（E对），支配面部诸表情肌。